濡脉与弱脉的主要不同点，在于
A. 脉位的浮沉
B. 脉力的大小
C. 脉形的长短
D. 脉率的快慢
E. 脉律的齐否

正确答案：A。脉位的浮沉

解析：濡脉的脉象特点是位浮、形细、势软；弱脉的脉象特点是位沉、形细、势软。故濡脉和弱脉的主要不同点在于脉位的浮沉（A对）。濡脉和弱脉的脉力都是小的（B错）。濡脉与弱脉的脉形细，非长非短（C错）。濡脉与弱脉的脉率是慢的（D错）。濡脉与弱脉脉律是整齐的（E错）。